队列研究中，如果随访时间较长，观察人数变动较大时，多采用下列哪种指标表示发病水平
A. 年发病率
B. 发病密度
C. 累积发病率
D. 罹患率
E. 以上均不对

正确答案：B。发病密度

解析：本题考查发病密度的概念。发病密度（B对ACDE错）是指用人时为单位计算出来的带有瞬时频率性质的率，反映的是速率。当研究对象进出队列的时间先后不一，整个队列呈现动态状态时，需用发病密度进行计算。